主动脉瓣狭窄时主要引起
A. 右心室容量负荷增加
B. 左心室压力负荷增加
C. 心肌结构损害
D. 心肌能量代谢障碍
E. 右室压力负荷增加

正确答案：B。左心室压力负荷增加

解析：主动脉瓣狭窄时，左心室射血所要克服的阻力即压力负荷增加（B对）。右心室容量负荷增加（A错）主要见于三尖瓣或肺动脉瓣关闭不全等。心肌结构损害（C错）时，心肌收缩性降低，主要见于心肌梗死、心肌炎、心肌病等。心肌能量代谢障碍（D错）可见于冠心病、心肌肥大等。右室压力负荷增加（E错）主要见于肺动脉高压和肺动脉瓣狭窄等。